配伍组方差分析中，若总例数为N，处理组数为k，配伍组数为b，则SS误差的自由度为
A. N－k
B. N－b
C. N－b－k
D. N－b－k－1
E. N－b－k+1

正确答案：E。N－b－k+1